某女，35岁。咽部红肿、疼痛，口干口渴；舌红苔黄，脉浮数。诊断为咽喉肿痛，证属风热外袭，宜选用的中成药是
A. 玄麦甘桔含片
B. 六神丸
C. 知柏地黄丸
D. 金参润喉合剂
E. 金嗓开音丸

正确答案：E。金嗓开音丸

解析：本题考查咽喉肿痛之风热外袭证的常用中成药应用。诊断为咽喉肿痛，证属风热外袭，宜选用的中成药是金嗓开音丸（E对）。咽喉肿痛之风热外袭证【症状】咽部疼痛，逐渐加重，吞咽或咳嗽时疼痛加剧，咽部红肿，颌下有券核；伴见发热恶风，头痛，咳嗽痰黄。舌质红，苔黄，脉浮数。【中成药应用】常用中成药清咽利膈丸、金嗓开音丸、复方鱼腥草片。咽喉肿痛之虚火上炎证【症状】咽部干燥，微痛，干痒，灼热，有异物感，干咳少痰，或痰中带血；或伴颧红潮热，耳鸣多梦。舌红，苔少，脉细数。【中成药应用】常用中成药玄麦甘桔含片（A错）、知柏地黄丸（C错）、金参润喉合剂（D错）。咽喉肿痛之火毒上攻证【症状】咽喉疼痛红肿，吞咽困难，咽喉如梗，咽部红肿明显，颌下有臖核、压痛，伴发热，口渴喜饮，疼痛剧烈，小便短赤，大便秘结。舌质红，苔黄，脉数有力。【中成药应用】常用中成药板蓝根颗粒、六神丸（B错）。